用量过大可引起低血糖反应的药物是
A. 糖皮质激素
B. 胰岛素
C. 甲状腺素
D. 炔雌醇
E. 螺内酯

正确答案：B。胰岛素

解析：本题考查胰岛素的不良反应。胰岛素（B对）能够降低血糖，大量使用会引起低血糖。糖皮质激素（A错）可抑制小肠对钙的吸收，促进尿钙的排泄，通过促进破骨细胞介导的骨吸收和抑制成骨细胞介导的骨形成引起骨质疏松。甲状腺素（C错）能够维持机体正常生长发育，过量给药引起甲状腺功能亢进，甲状腺肿大，偶见骨质疏松。炔雌醇（D错）属于雌激素，有促进骨质致密的作用。螺内酯（E错）是利尿剂，其长期使用易引起高钾血症，多与排钾利尿药合用。